质量要求制定指纹图谱的中药剂型是
A. 丸剂
B. 散剂
C. 颗粒剂
D. 注射剂
E. 胶囊剂

正确答案：D。注射剂

解析：本题考查质量要求制定指纹图谱的中药剂型。质量要求制定指纹图谱的中药剂型是注射剂（D对）。中药指纹图谱鉴定技术中药指纹图谱系指中药原料药材、饮片、半成品、成品等经适当处理后，采用一定的分析手段，得到的能够标示其特征的共有峰的图谱，能客观地揭示和反映中药内在质量的整体性和特征性，用以评价中药的真实性、有效性、稳定性和一致性。国家药品监督管理部门在2000年颁布了《中药注射剂指纹图谱研究的技术要求》（暂行），2002年又颁布了《中药注射剂指纹图谱试验操作规程指南》，并先后发布了2004版和2012版《中药色谱指纹图谱相似度评价系统》，详细规定了原料药材、半成品、成品的供试品收集与制备及制定指纹图谱的各项技术要求和方法。